合成胆固醇的限速酶是
A. HMGCoA合成酶
B. HMGCoA裂解酶
C. HMGCoA还原酶
D. 鲨烯环氧酶
E. 甲羟戊酸激酶

正确答案：C。HMGCoA还原酶

解析：五种酶都参与胆固醇代谢，但HMGCoA还原酶是唯一的限速酶；该酶受激素调节；胰高血糖素通过促使该酶磷酸化而失活，胰岛素则促进去磷酸化而恢复活性（C对）。